传导听觉的丘系是
A. 外侧丘系
B. 内侧丘系
C. 脊髓丘系
D. 三叉丘系
E. 红核

正确答案：A。外侧丘系

解析：传导听觉的丘系是外侧丘系（A对）；内侧丘系(B错)传递对侧躯干和上、下肢的意识性本体感觉和精细触觉；脊髓丘系（C错）传递对侧躯干 、四肢 的痛、温觉和粗略触压觉；三叉丘系（D错）传导对侧头面部皮肤、牙及口、鼻黏膜的痛、温觉，也传递双侧同区域的触压觉；红核（E错）主要兴奋屈肌运动神经元，同时抑制伸肌运动神经元。